治疗血瘀气滞，经行腹痛，兼风湿肩臂疼痛者，应选用
A. 桃仁
B. 丹参
C. 红花
D. 姜黄
E. 益母草

正确答案：D。姜黄

解析：血瘀气滞，经行腹痛，治益活血行气，风湿肩臂疼痛，治益通经络，祛风湿除痹痛。姜黄具有活血行气，痛经止痛的功效，尤长于行肢臂而除痹痛（D对）。桃仁具有活血祛瘀，润肠通便，止咳平喘的功效，无祛风湿除痹痛之功（A错）。丹参具有活血调经，祛瘀止痛，凉血消痈，除烦安神的功效，无祛风湿除痹痛之功（B错）。红花具有活血通经，祛瘀止痛的功效，无祛风湿除痹痛之功（C错）。益母草具有活血调经，利水消肿，清热解毒的功效，无祛风湿除痹痛之功（E错）。